错误的是
A. 位于中央前回和旁中央小叶前部
B. 在皮质上呈倒立式投影
C. 支配对侧肢体的随意运动
D. 位于一般躯体感觉中枢的前方
E. 支配同侧半身的随意运动

正确答案：E。支配同侧半身的随意运动

解析：运动中枢（即第Ⅰ躯体运动区）位于中央前回和中央旁小叶前部（A对），一般躯体感觉中枢的前方（D对）。运动中枢对骨骼肌运动的管理有一定的局部定位关系：①在皮质上呈倒立式投影（B对），即皮质中越靠上的部分控制人体越靠下的部分；②左右交叉，即一侧运动中枢支配对侧半身的随意运动（C对E错，为本题正确答案）；③身体各部分投影区的大小与各部形体大小无关，而取决于功能的重要性和复杂程度。